咳嗽是机体的一种反射性防御动作，有利于清除呼吸道分泌物或异物，但频繁剧烈的咳嗽会影响患者的工作和生活。关于咳嗽的用药指导与患者教育，正确的有
A. 对痰液较多的湿性咳嗽，应以祛痰为主
B. 过敏性鼻炎引起的鼻后滴漏综合征所致咳嗽，应给予鼻用糖皮质激素
C. 有长期吸烟史的老年人，当出现无明显诱因的刺激性干咳，应先排除肺癌
D. 感冒后的咳嗽常为自限性，通常可自行缓解
E. ACEI类药物诱发的干咳，应使用右美沙芬

正确答案：A、B、C、D。对痰液较多的湿性咳嗽，应以祛痰为主；过敏性鼻炎引起的鼻后滴漏综合征所致咳嗽，应给予鼻用糖皮质激素；有长期吸烟史的老年人，当出现无明显诱因的刺激性干咳，应先排除肺癌；感冒后的咳嗽常为自限性，通常可自行缓解

解析：本题考查咳嗽患者教育。咳嗽患者用药指导与教育：（1）临床上，咳嗽原因很多，关键是查清病因，对因治疗。感冒后的咳嗽常具自限性，通常可自行缓解（D对）；抗菌药物治疗无效。对一些慢性迁延性咳嗽可以短期应用抗组胺H₁受体阻断剂及中枢性镇咳药。过敏性鼻炎引起的鼻后滴漏所致咳嗽，应使用鼻用糖皮质激素（B对）。对合并气管-支气管炎、肺炎和支气管哮喘的咳嗽患者，在止咳、平喘的同时，宜注意控制感染和炎性因子，遵医嘱服用抗感染药物，消除炎症才能使镇咳药获得良好的效果。有长期吸烟史的老年人，出现无明显诱因的刺激性干咳，应先排除肺癌（C对）。对持续1周以上并伴有发热、皮疹、哮喘及肺气肿的咳嗽，应及时去医院明确诊断。（2）咳嗽分为干咳或湿咳，对干咳可单用镇咳药；对痰液较多的湿咳则应以祛痰为主（A对），不宜单纯使用镇咳药，应与祛痰剂合用，以利于痰液排出和加强镇咳效果。对痰液特别多的湿性咳嗽，应该慎重使用镇咳药，以免痰液排出受阻而滞留于呼吸道内或加重感染。（3）对于服用血管紧张素转换酶抑制剂（ACEI）诱发的咳嗽，发生率5%～25%，在慢性咳嗽中的比例为1.7%～12%。停药后1～4周咳嗽消失或明显减轻（E错）。（4）注意药物不良反应。如右美沙芬可引起嗜睡，对驾车、高空作业或操作机器者宜慎用。苯丙哌林对口腔黏膜有麻醉作用，产生麻木感觉，服药时需整片吞服，不可嚼碎。青光眼、心功能不全者慎用喷托维林；有报道喷托维林可造成儿童呼吸抑制，故5岁以下儿童不宜应用。（5）咳嗽患者除用药外还应注意休息，戒烟禁酒，忌食刺激性或辛辣食物。